蛛网膜下腔出血属于
A. 缺血性脑卒中
B. 出血性脑卒中
C. 脑瘤
D. 脑疝
E. 脑炎

正确答案：B。出血性脑卒中

解析：按照病因和病理机制，可以将脑卒中分为缺血性卒中和出血性卒中，前者及所谓的“脑梗死”，后者包括脑出血以及蛛网膜下腔出血。掌握“脑卒中”知识点。